男，45岁。体检发现空腹血糖8mmol/L，餐后2h血糖13mmol/L，血清甘油三酯3.5mmol/L，低密度酯蛋白胆固醇3.6mmol/L。无明显不适，半年内体重下降10kg。查体：BP160/100mmHg，BMI28，心肺查体无阳性发现。该患者首选的调脂药物是
A. 他汀类
B. 多烯酸乙酯
C. 贝特类
D. 维生素E
E. 烟酸类

正确答案：A。他汀类

解析：①体重指数（BMI） ＜ 18 . 5 为体重过低， 18 . 5 - 23.9 为体重正常， 24.0-27.9 为超重，≥28 为肥胖。患者BMI=28， 说明为肥胖体型。患者45 岁，空腹血糖＞7. 0mmol/L， 餐后2 小时血糖＞11.lmmol/L， 应诊断为2 型糖尿病。②血清正常值：甘油三酯0.56- l.7mmol/L， 总胆固醇＜ 5 . 2mmol/L， 低密度脂蛋白＜3.6lmmol/L 。9版内科学P743 观点为：糖尿病患者调脂治疗的首要目标是 LDL- C 。 LDL-C一般控制目标 ＜2 . 6mmol/ L， 极高危病人 ＜ l. 8mmol/ L或较基线降低 50% 。首选他汀类药物（A对）并长期坚持使用…如 TG＞5. 7mmol/ L， 应先用贝特类药物（C错）， 以减少发生急性胰腺炎的风险。多烯酸乙酯、烟酸类均不是高脂血症的首选药物。VitE 不属于调脂药物。